下列关于特殊黏膜叙述错误的是
A. 特殊黏膜为舌背黏膜
B. 在功能上属咀嚼黏膜
C. 无延伸度
D. 部分乳头上皮内还有味觉感受器
E. 其表面有许多不同类型的乳头

正确答案：C。无延伸度

解析：特殊黏膜为舌背黏膜，在功能上属咀嚼黏膜，但又有相当的延伸度，有被覆黏膜的特点。最主要的是其表面有许多不同类型的乳头，部分乳头上皮内还有味觉感受器。掌握“口腔黏膜基本结构”知识点。